关于外周神经冲动能否传入高级神经中枢引起疼痛的学说是
A. 闸门控制学说
B. 神经传导学说
C. 牙本质传导学说
D. 流体动力学理论
E. 以上都不对

正确答案：A。闸门控制学说

解析：本题考查闸门控制学说。闸门控制学说是关于牙髓炎症时引起疼痛的学说，即外周神经冲动能否传入高级神经中枢引起疼痛（A对）。关于牙本质过敏的发生机制，代表性学说有3个：分别为神经终末传导学说、成牙本质细胞传导学说和液体动力学说。神经终末传导学说认为牙本质中存在着牙髓神经，对外界的感觉可由牙本质传至牙髓（B错）。牙本质细胞传导学说认为牙本质细胞突起与神经之间存在突触样关系，能行使神经感受器的功能，将受到的刺激传给神经末梢，然后传至中枢；但在成牙本质细胞的原浆中没有发现神经传导必需的乙酰胆碱样物质（C错）。流体动力学说认为作用于牙本质表面的刺激会引起牙本质小管内的液体发生多向流动，这种流动传到牙髓，会引起牙髓神经纤维的兴奋而产生痛觉（D错）。